蛋白质生物合成的直接模板是
A. DNA
B. siRNA
C. mRNA
D. rRNA
E. tRNA

正确答案：C。mRNA